女性患者，56岁，因急性白血病并发DIC高凝状态入院，针对诊断明确的DIC高凝期，应及早使用
A. 凝血因子
B. 全血
C. 肝素
D. 抗纤溶治疗
E. 抗高血压药物

正确答案：C。肝素

解析：对于诊断明确的DIC，应及早使用肝素，最好在高凝期应用。掌握“弥散性血管内凝血（DIC）”知识点。